重金属毒物和某些难降解的毒物，随着食物链的延长，使处于高位级的生物体内的浓度比处于低位级的生物体内的浓度逐渐增多加大，称为
A. 生物放大作用
B. 生物蓄积作用
C. 生物浓缩作用
D. 生物相互作用
E. 生物降解作用

正确答案：A。生物放大作用

解析：本题考查生物放大作用。重金属毒物和某些难降解的毒物，随着食物链的延长，使处于高位级的生物体内的浓度比处于低位级的生物体内的浓度逐渐增多加大，称为生物放大作用（A对BCDE错）。